患者，男，62岁。高血压病史10年，既往有骨关节炎和血脂异常，轻度心功能不全。近期体检发现血压162/80mmHg，心率72次/分。该患者目前服用的药物除抗高血压药外有辛伐他汀、双氯芬酸、氨基葡萄糖、甲钴胺及碳酸钙D。该患者所服用的几种药物中，有可能使降压的疗效减弱的是
A. 辛伐他汀
B. 碳酸钙D
C. 氨基葡萄糖
D. 双氯芬酸
E. 甲钴胺

正确答案：B。碳酸钙D

解析：本题考查维生素D。碳酸钙D（B对）中含有碳酸钙和维生素D，因此有可能使降压的疗效减弱。